盆腔炎性疾病的最低诊断标准是
A. 红细胞沉降率升高
B. 血C反应蛋白升高
C. 宫颈举痛或子宫压痛或附件区压痛
D. 宫颈脓性分泌物
E. 体温超过38.3

正确答案：C。宫颈举痛或子宫压痛或附件区压痛

解析：盆腔炎性疾病的最低诊断标准是子宫颈举痛或子宫压痛或附件区压痛（C对）。红细胞沉降率升高（A错）、血C反应蛋白升高（B错）、宫颈脓性分泌物（D错）和体温超过38.3（E错）属于附加标准，不是最低标准。